舌苔干燥，扪之无津，甚则干裂的舌象是
A. 滑苔
B. 燥苔
C. 糙苔
D. 润苔
E. 腻苔

正确答案：B。燥苔

解析：本题主要考查苔质。燥苔的舌苔干燥，扪之无津，甚则舌苔干裂（B对）提示体内津液已伤。滑苔的舌面水分过多，伸舌欲 滴，扪之湿滑（A错）。糙苔的苔质粗糙，扪之碍手（C错）。润苔的舌苔润泽有津，干湿适中，不滑不燥（D错）。腻苔的苔质致密，颗粒细小，融合成片，如涂有油腻之状，中间厚边周薄，紧贴 舌面，揩之不去，刮之不脱（E错）。